子宫颈鳞状上皮在HPV的刺激下，可形成宫颈上皮内瘤变（CIN），关于CIN的转归，下列说法错误的是
A. 消退
B. 逆转
C. 稳定
D. 癌变
E. 休眠

正确答案：E。休眠

解析：子宫颈移行带表面的上皮，在HPV病毒的刺激下，有可能发生宫颈上皮内瘤变（CIN），其转归有如下三种形式：消退（或逆转）；持续不变（或病情稳定）；进展（或癌变）。其过程是动态的，而不是完全静止的。掌握“宫颈癌”知识点。